虚人感受外邪，应采用的是
A. 治标
B. 治本
C. 标本兼治
D. 先治本后治标
E. 反治

正确答案：C。标本兼治

解析：标本兼治适用于标本并重或标本俱缓，但单纯治标或治本都不易收效的情况；患者本身正气虚，又感受外邪，此时标本俱急，治宜应扶正祛邪并用，属于标本兼治（C对）。治标适用于标症紧急时，若不及时处理会危及生命，当以控制症状为首务（A对）；治本适用于病情缓和，病势迁延，暂无急重病症的情况（B错）；标本的先后缓急取舍，应当根据病情的实际情况而定（D错）；反治适用于疾病的征象与其本质不完全一致的情况（E错）。